关于使用金银花露注意事项的说法，错误的是
A. 不宜与温热性中药同时服用
B. 不宜与滋补性中药同时服用
C. 孕妇、年老体弱者慎用
D. 小儿痱毒者慎用
E. 脾胃虚弱者慎用

正确答案：D。小儿痱毒者慎用

解析：本题考查的是金银花露的注意事项。关于使用金银花露注意事项的说法，错误的是小儿痱毒者慎用（D错）。金银花露【注意事项】1.服药时饮食宜清淡。2.服用本药时，不宜与温热性中药同时服用（A对），不宜同时服滋补性中成药（B对）。3.脾虚大便溏者慎服（E对）。4.高血压、心脏病、肝病、糖尿病、肾病等慢性病严重者应在医师指导下服用。5.按照用法用量服用，婴幼儿、孕妇及年老体虚者应在医师指导下服用（C对）。